葡萄糖的特征物理常数是
A. 比旋度
B. 熔点
C. 折光率
D. 吸收系数
E. 相对密度

正确答案：A。比旋度

解析：本题考查葡萄糖的分析。葡萄糖具有旋光性，比旋度（A对）是其重要的物理常数，测定比旋度可以鉴别药物，也可以反映药物的纯杂程度。